感冒的治疗，可分别采用辛温解表或辛凉解表，此属于
A. 辨病论治
B. 因人制宜
C. 同病异治
D. 异病同治
E. 对症论治

正确答案：C。同病异治

解析：感冒的致病因素有很多，可以是感受风寒也可以是感受风热，所以针对不同的病因可以选用不同的治疗方法，符合同病异治的理念。（C对）。辨证论治（A错）是运用中医学理论辨析相关临床资料以明确病变本质并确立证，论证其治则治法方药并付诸实施的思维和实践过程。异病同治（D错）是指几种不同的疾病，在其发展变化过程中出现了大致相同的病机，表现为大致相同证，因为采用大致相同的治法和方药来治疗。对症论治（E错）是根据辨证的结果确立相应的治疗原则和方法及方药，选择适当的治疗手段和措施来处理疾病的思维和实践过程。